能消炎解毒、和胃止酸、消食化痞的藏成药是
A. 洁白丸
B. 仁青常觉
C. 大月晶丸
D. 八味沉香散
E. 十一味金色丸

正确答案：C。大月晶丸

解析：本题考查的是大月晶丸的功能与主治。能消炎解毒、和胃止酸、消食化痞的藏成药是大月晶丸（C对）。大月晶丸的功能与主治：消炎解毒，和胃止酸，消食化痞。洁白丸（A错）的功能与主治：健脾和胃，止痛止吐，分清泌浊。用于胸腹胀满，胃脘疼痛，消化不良，呕吐泄泻，小便不利。仁青常觉（B错）的功能与主治：清热解毒，调和滋补。用于“隆、赤巴、培根”各病，陈旧性胃肠炎、溃疡，“木布”病，萎缩性胃炎，各种中毒症；梅毒，麻风，陈旧热病，炭疽，疖痛，干黄水，化脓等。八味沉香散（D错）：的功能与主治：清心热，养心，安神，开窍。用于热病攻心，神昏谵语；冠心病，心绞痛。十一味金色丸（E错）的功能与主治：清热解毒，化瘀。用于胆囊痞肿，巩膜黄染，消化不良，中毒症。对黄疸性肝病疗效最佳。